下列哪项不是阳水证的临床表现
A. 起病急，病程短
B. 水肿先从头面肿起
C. 上半身肿甚
D. 水肿皮薄光亮
E. 肢冷，腰痠痛

正确答案：E。肢冷，腰痠痛

解析：阴水是因脾虚水肿，久延不愈，伤及肾阳，或肾阳亏虚，开合不利，水液不能排泄所致。肾阳虚不能温煦肢体可见肢冷，不能温养腰膝可见腰痠痛，故为阴水证非阳水证的临床表现（E对）。阳水证是指水肿性质属实者。起病急，病程短，水肿皮薄光亮，上半身肿甚，均是因上焦失宣，中焦失布，下焦失司，三焦俱病，水无去路，泛溢肌肤所致，故为阳水的临床表现（ACD错）。水肿先从头面肿起是因肺位上焦，宣发受阻，水液停滞所致，故为阳水的临床表现（B错）。